全口义齿蜡型试戴需检查的内容为
A. 正中关系
B. 颌位关系
C. 发音检查
D. 垂直距离
E. 以上都是

正确答案：E。以上都是

解析：本题考查全口义齿排牙及蜡型试戴。全口义齿蜡型试戴是在义齿排牙和基托蜡型完成后，将义齿蜡型放入患者口中进行试戴。检查的内容有：①检查蜡型基托是否贴合，有无翘动，扭转；②验证颌位关系（B对），包括验证垂直距离（D对），验证正中关系（A对）；③检查人工牙排列与美观效果，包括前牙，后牙；④检查发音（C对），包括唇音、唇齿音、舌齿音、舌腭音、齿音、哨音等内容。以上均是需检查的内容，因此选E。